以下有关药品商品名管理规定的表述，正确的是
A. 未经国家食品药品监督管理局批准作为商品名使用的注册商标，不准印刷在包装标签上
B. 药品通用名称与商品名称用字的比例不得小于三分之一
C. 药品商品名称须经省级以上药品监督管理部门同意方可在药品包装、标签及说明书上标注
D. 药品商品名不得与通用名连写，应分行
E. 药品商品名应该以黑体正楷印刷

正确答案：D。药品商品名不得与通用名连写，应分行

解析：本题考查商品名称。药品商品名不得与通用名连写，应分行（D对），其字体和颜色不得比通用名称更突出和显著（E错），其字体以单字面积计不得大于通用名称所用字体的二分之一（B错）。药品说明书和标签中禁止使用未经注册的商标以及其他未经国家药品监督管理部门批准的药品名称，而不是禁止使用未经国家食品药品监督管理局批准作为商品名使用的注册商标（A错）。